有关PVA17～88的正确表述有
A. 常用作可生物降解性植入剂材料
B. 常用作膜剂的成膜材料
C. 其平均聚合度为500～600
D. 其醇解度为88%
E. 其水溶性小，柔韧性好

正确答案：B、D、E。常用作膜剂的成膜材料；其醇解度为88%；其水溶性小，柔韧性好